能产生肠毒素，对肠黏膜组织无损伤，大便镜检偶见白细胞
A. 轮状病毒
B. 产毒性大肠杆菌
C. 致病性大肠杆菌
D. 侵袭性大肠杆菌
E. 白色念珠菌

正确答案：B。产毒性大肠杆菌

解析：产毒性细菌引起的肠炎，起病较急，轻症仅有大便次数稍增，性状轻微改变，重症腹泻较频繁，量多。能产生肠毒素，对肠黏膜组织无损伤；镜检无白细胞或偶见白细胞（B对）。轮状病毒肠炎大便镜检有少量白细胞。感染后1～3天即有大量病毒自大便中排出，最长可达6天。血清抗体一般在感染后3周上升。病毒较难分离，有条件可直接用电镜或免疫电镜检测病毒，或用大便乳胶凝集试验检测病毒抗原，或PCR及核酸探针技术检测病毒基因（A错）。致病性大肠杆菌分为侵入型和毒素型两类。前者引起的腹泻与痢疾杆菌引起的痢疾相似，一般称为急性痢疾型；后者所引起的腹泻为胃肠炎型，一般称为急性胃肠炎型（C错）。侵袭性大肠杆菌可直接侵袭小肠或结肠肠壁，使黏膜充血、水肿，炎症细胞浸润引起渗出和溃疡等病变。患儿排出大量白细胞和红细胞的菌痢样粪便（D错）。真菌性肠炎多为白色念珠菌所致，大便次数增多，黄色稀便，泡沫较多，带黏液，有时可见豆腐渣样细块（菌落）。大便镜检有真菌孢子和菌丝（E错）。